高分子化合物的生产过程，一般可以分为以下四个步，其中哪一个步过程中工人接触毒物的机会较少
A. 基本的化工原料
B. 合成单体
C. 单体缩合
D. 聚合物树脂加工塑制成成品

正确答案：D。聚合物树脂加工塑制成成品

解析：本题考查高分子合成的步骤。高分子化合物的生产过程，可分为四个部分：①生产基本的化工原料；②合成单体；③单体聚合或缩聚；④聚合物树脂的加工塑制和制品的应用。而高分子化合物对健康的影响主要来自三个方面：①制造化工原料（A错）、合成单体（B错）的生产过程；②生产中的助剂；③高分子化合物在加工（C错）、受热时产生的毒物。聚合物树脂加工塑制成成品（D对）产生的有害物质相对较少。